男性，18岁学生，不出门怕见人，不去上课，纠缠父母出钱给自己做美容手术半年。原因是半年来反复照镜子发现自己的鼻子比以前变大了，难看了。说班上的同学都讥笑他，出门就感觉别人在说他，别人的眼光看他时很特别，能使他头痛。父母不愿意出钱就说父母不关心他，父母不是亲生的，曾说要去做亲子鉴定。如给予药物治疗，下列不属于抗精神病药的是
A. 氟哌啶醇
B. 氟奋乃静
C. 氟西汀
D. 氯氮平
E. 三氟拉嗪

正确答案：C。氟西汀

解析：氟西汀属于选择性5-羟色胺再摄取抑制剂（SSRIs）的抗抑郁药物（C错，为本题正确答案）。氟哌啶醇、氟奋乃静、三氟拉嗪属于第一代抗精神病药物（ABE对）。氯氮平属于第二代抗精神病药物（D对）。